一般问题解决模式包含发现问题、分析问题、提出假设、实践和检验假设的几个要素，那么心理治疗过程中哪个阶段相当于提出假设
A. 问题探索阶段
B. 分析认识阶段
C. 治疗行动阶段
D. 结束巩固阶段
E. 以上都不是

正确答案：B。分析认识阶段